黏液外渗性囊肿和黏液潴留囊肿的统称为
A. 外渗性囊肿
B. 潴留囊肿
C. 炎症性囊肿
D. 癌性囊肿
E. 黏液囊肿

正确答案：E。黏液囊肿

解析：黏液囊肿是黏液外渗性囊肿和黏液潴留囊肿的统称。掌握“黏液囊肿”知识点。